下列关于酮体的描述错误的是
A. 酮体包括乙酰乙酸，β-羟丁酸和丙酮
B. 合成原料是丙酮酸氧化生成的乙酰CoA
C. 只能在肝的线粒体内生成
D. 酮体只能在肝外组织氧化
E. 酮体是肝输出能量的一种形式

正确答案：B。合成原料是丙酮酸氧化生成的乙酰CoA

解析：酮体包括乙酰乙酸、β-羟丁酸和丙酮（A对），合成原料是脂肪酸氧化生成的乙酰CoA（B错，为本题正确答案），只能在肝线粒体中由酮体合成酶系催化生成（C对）。酮体是肝输出能量的一种形式（E对），肝组织缺乏利用酮体的酶系，只能在肝外组织氧化（D对）。肝外许多组织具有活性很强的酮体利用酶，能将酮体重新裂解成乙酰CoA，通过柠檬酸循环彻底氧化。